有关心的静脉，以下哪一项是错误的
A. 心前静脉起于右心室
B. 心中静脉与后室间支伴行
C. 心小前壁静脉在冠状沟内与右冠状动脉伴行
D. 心的所有静脉均注入冠状窦
E. 心大静脉与前室间支伴行

正确答案：D。心的所有静脉均注入冠状窦

解析：心前静脉起于右心室（A对）。心中静脉与后室间支伴行（B对）。心小前壁静脉在冠状沟内与右冠状动脉伴行（C对）。并不是心的所有静脉均注入冠状窦（D错，为本题正确答案），亦有些小静脉可以直接注入心腔。心大静脉与前室间支伴行（E对）。